根据《疫苗流通和预防接种管理条例》，不属于第一类疫苗的是
A. 县级以上人民政府组织的应急接种疫苗
B. 卫生主管部门组织的群体性预防接种所使用的疫苗
C. 公民自费并且自愿受种的疫苗
D. 政府免费向公民提供的疫苗
E. 公民应依照政府的规定受种的疫苗

正确答案：C。公民自费并且自愿受种的疫苗

解析：本题考查疫苗的分类。根据《疫苗流通和预防接种管理条例》，公民自费并且自愿受种的疫苗属于第二类疫苗（C错，为本题正确答案）。《疫苗流通和预防接种管理条例》第一章总则第二条：疫苗分为两类。第一类疫苗，是指政府免费向公民提供（D对），公民应当依照政府的规定受种的疫苗（E对），包括国家免疫规划确定的疫苗，省、自治区、直辖市人民政府在执行国家免疫规划时增加的疫苗，以及县级以上人民政府或者其卫生主管部门组织的应急接种或者群体性预防接种所使用的疫苗（AB对）；第二类疫苗，是指由公民自费并且自愿受种的其他疫苗。